临床常见的心火引动肝火的病证是
A. 相侮
B. 相乘
C. 子病犯母
D. 母病及子
E. 母子同病

正确答案：C。子病犯母

解析：五行之中，心属火，肝属木，木生火，心火引动肝火是子病犯母（C对）。相侮指五行中所胜一行对其所不胜一行的反向制约和克制（A错）。相乘指五行中所不胜一行对其所胜一行的过度制约或克制（B错）。母病及子是指五行中的某一行异常，累及其子行，导致母子两行皆异常（D错）。母子同病是母子同时得病，而题中的心火引动肝火有先后顺序（E错）。